某女，31岁。每年春天皮肤起风团，色鲜红，灼热剧痒，症状加重时伴有发热恶寒咽喉疼痛不适，舌红，苔薄黄，脉浮数。宜选用的方剂是
A. 香薷饮加减
B. 防风汤加减
C. 杏苏散加减
D. 消风散加减
E. 银翘散加减

正确答案：D。消风散加减

解析：本题考查的是瘾疹的辨证论治。每年春天皮肤起风团，色鲜红，灼热剧痒，症状加重时伴有发热恶寒咽喉疼痛不适，舌红，苔薄黄，脉浮数。宜选用的方剂是消风散加减（D对）。瘾疹风热犯表证：【症状】风团鲜红，灼热剧痒，遇热则剧，得冷则减；伴发热，恶寒，咽喉肿痛。舌质红，苔薄白或薄黄，脉浮数。【方剂应用】基础方剂为消风散（荆芥、防风、当归、生地、苦参、苍术、蝉蜕、胡麻仁、牛蒡子、知母、石膏、甘草、木通）加减。香薷饮加减（A错）为中暑阴暑的方剂应用。中暑阴暑：【症状】发热恶寒，无汗，身重疼痛，神疲倦怠。舌质淡，苔薄黄，脉弦细。【方剂应用】基础方剂为香薷饮（香薷、厚朴、白扁豆）加减。防风汤加减（B错）为痹证行痹的方剂应用。痹证行痹：【症状】肢体关节、肌肉疼痛酸楚，关节屈伸不利，可涉及肢体多个关节，疼痛呈游走性，初起可见恶风、发热等表证。舌苔薄白，脉浮或浮缓。【方剂应用】基础方剂为防风汤（防风、当归、茯苓、杏仁、黄芩、秦艽、葛根、麻黄、桂枝、生姜、甘草、大枣）加减。风热感冒：【症状】身热较著，微恶风，头胀痛，或咳嗽少痰，或痰出不爽，咽痛咽红，口渴。舌边尖红，苔薄白或微黄，脉浮数。【方剂应用】基础方剂为银翘散（金银花、连翘、竹叶、荆芥、牛蒡子、薄荷、桔梗、淡豆豉、甘草）加减。方剂应用为杏苏散加减（C错）的病证，2022年考试指南未明确说明。